患者，男，30岁。暴饮后出现胃脘胀满，口渴欲饮，饮水即吐，胃肠有振水音，苔白滑，脉弦，此属
A. 饮停胸胁
B. 寒邪客胃
C. 脾胃虚寒
D. 饮留胃肠
E. 寒湿困脾

正确答案：D。饮留胃肠

解析：水饮留胃，则胃脘胀满。因脾胃阳虚，饮停胃肠，致津液输布障碍，阳气不能气化津液上承于口，故见口渴喜热饮；饮后水停胃肠更甚，胃失和降而上逆，故水入即吐。饮邪从胃下流于肠，则肠间沥沥有声。脉沉弦或伏，舌苔白腻为水饮壅盛，阳气郁遏之象。故辨证为饮留胃肠证（D对）。饮停胸胁证，临床表现为胸廓饱满，胸胁部胀闷或痛，呼吸、咳嗽或转侧时牵引作痛，或伴头晕目眩，舌苔白滑，脉沉弦（A错）。寒邪客胃证主要表现为胃脘冷痛、恶心呕吐及实寒症状（B错）。脾胃虚寒证临床表现为胃痛隐隐，绵绵不休，冷痛不适，喜温喜按，空腹痛甚，得食则缓，劳累或食冷或受凉后疼痛发作或加重，泛吐清水，食少，神疲乏力，手足不温，大便溏薄，舌淡苔白，脉虚弱（C错）。寒湿困脾证以以脘腹痞闷、纳呆、便溏、身重与寒湿症状为主要表现（E错）。